奶的高温消毒应选用
A. 62～65℃，30秒
B. 62～65℃，30分钟
C. 72～75℃，15～16秒
D. 72～75℃，15～16分钟
E. 80℃，10分钟

正确答案：C。72～75℃，15～16秒